下列各项，不属急惊风病因的是
A. 风寒
B. 湿热
C. 惊恐
D. 风热
E. 体虚

正确答案：E。体虚

解析：急惊风为痰、热、惊、风四证俱备，临床以高热、抽风、神昏为主要表现，多由外感时邪、内蕴湿热（B对）和暴受惊恐（C对）而引发；小儿肌肤薄弱，卫外不固，若冬春之季，寒温不调，气候骤变，感受风寒（A对）或风热之邪（D对），邪袭肌表或从口鼻而入，易于传变，郁而化热，热极生风。体虚多易导致慢惊风（E错，为本题正确答案）。